女，76岁。持续性心房颤动2年，有脑血栓和糖尿病病史。查体：BP120/65mmHg，心率87次/分，心脏各瓣膜区未闻及杂音。该患者最适宜的抗栓措施是
A. 皮下注射低分子肝素
B. 静脉滴注肝素
C. 口服阿司匹林
D. 口服氯吡格雷
E. 口服华法林

正确答案：E。口服华法林

解析：患者老年女性，心脏各瓣膜区未闻及杂音（提示为非瓣膜病患者）需使用CHADS₂评分法对患者进行危险分层。患者年龄为76岁＞75岁（2分），脑血栓（2分），糖尿病（1分），可得该患者CHADS₂评分为5分，故该患者最适宜的抗栓措施是口服华法林（E对）。皮下注射低分子肝素（A错）、静脉滴注肝素（B错）在房颤治疗中主要用于紧急复律治疗时的抗凝。阿司匹林、氯吡格雷均为抗血小板制剂。阿司匹林（P226）主要是通过抑制环氧化酶和血栓烷A₂的合成达到抗血小板聚集的作用；氯吡格雷（P226）主要是通过选择性不可逆的抑制血小板二磷酸腺苷（ADP）受体而阻断ADP依赖激活的血小板糖蛋白Ⅱb/Ⅲa复合物，有效地减少ADP介导的血小板激活和聚集。口服阿司匹林（C错）和口服氯吡格雷（D错）俗称双抗治疗，多用于急性冠脉综合征的抗血小板治疗，预防血栓的形成，少见于房颤患者的抗栓治疗。